小儿肾积水患者常见的梗阻部位
A. 肾盂
B. 肾盂+输尿管
C. 输尿管膀胱交接部梗阻
D. 输尿管
E. 尿道

正确答案：B。肾盂+输尿管

解析：小儿肾积水患者常见的梗阻部位为肾盂输尿管连接处（B对）。肾盂梗阻一般少见（A错）。上尿路急性时梗阻一般会发生常常出现肾绞痛、恶心、呕吐、血尿及肾区压痛。上尿路慢性梗阻由于发展常较缓慢，症状不明显或仅有腰部隐痛不适，当发展成巨大肾积水时，腹部可出现肿块（ACD错）。下尿路梗阻时，主要表现为排尿困难和膀胱排空障碍，甚至出现尿潴留，而引起肾积水出现的症状常较晚，临床多表现为不同程度的肾功能损害（E错）。